下列哪项属流行病学实验性研究
A. 筛查早期患者
B. 分析危险因素暴露的结局
C. 探讨病因的线索
D. 评价某种预防措施的效果

正确答案：D。评价某种预防措施的效果

解析：本题考查实验流行病学的用途。实验流行病学的主要用途包括：①其检验因果关系假设的能力强于分析性研究，可以作为确证因果关系的最终手段；②用于评价疾病的防治效果；③评价单一干预措施或综合干预措施的效果（D对ABC错）；④评价保健策略和政策实施的效果；⑤在疾病治疗研究中可以评价单独一种药物、联合用药、手术或治疗方案的效果。